在总义齿的咬合中，出于义齿固位和稳定的需要，通常需要将工作侧和非工作侧的咬合都设计成有咬合接触的类型，这种咬合接触关系称为
A. 最大侧向颌位
B. 侧（牙合）颌位
C. 非工作侧（牙合）干扰
D. 侧向平衡（牙合）
E. 最大前伸颌位

正确答案：D。侧向平衡（牙合）

解析：在总义齿的咬合中，出于义齿固位和稳定的需要，通常需要将工作侧和非工作侧的咬合都设计成有咬合接触的类型，这种咬合接触关系称为侧向平衡（牙合），非工作侧称为平衡侧。掌握“下颌姿势位、三类颌位与前伸、侧方（牙合）颌位”知识点。